已知大肠癌在总人群中的患病率为41.9/10万，而在长期便秘的人群中患病率约为183/10万，可提高大肠癌筛检收益的方法是
A. 扩大筛查人群
B. 采用串联试验
C. 采用并联试验
D. 选择筛查高危人群
E. 增加筛查频率

正确答案：D。选择筛查高危人群

解析：本题考查可提高筛检收益的方法。疾病在某些年龄、性别、种族及主要危险因素暴露特征人群中有较高的患病率，在这些高危人群中开展筛检，可提高阳性预测值，也更符合低成本高效益的原则。本题可提高大肠癌筛检收益的方法是选择筛查高危人群（D对ABCE错）。